治疗慢性失血（如钩虫病）所致的贫血宜选用
A. 叶酸
B. 维生素K
C. 硫酸亚铁
D. 维生素B₁₂
E. 安特诺新

正确答案：C。硫酸亚铁

解析：本题考查硫酸亚铁。硫酸亚铁（C对）为铁剂，用于防治各种原因引起的缺铁性贫血。叶酸（A错）可用于各种原因引起的叶酸缺乏及叶酸缺乏所致的巨幼红细胞贫血。维生素B₁₂（D错）用于巨幼红细胞性贫血、神经炎、口炎性腹泻等一系列疾病。维生素K（B错）为促凝血药，用于维生素K缺乏症和双香豆素类抗凝药过量的解毒。安特诺新（E错）主要用于毛细血管通透性增加所致的出血。